最常见的肾盂肾炎病原菌是
A. 葡萄球菌
B. 粪肠球菌
C. 大肠杆菌
D. 变形杆菌
E. 白色念珠菌

正确答案：C。大肠杆菌

解析：最常见的肾盂肾炎病原菌是大肠杆菌（大肠埃希菌）（C对）。葡萄球菌（A错）易于引起侵袭性疾病，如皮肤化脓感染、各种器官以及全身感染；毒素性疾病，如食物中毒、烫伤样皮肤综合征、毒性休克综合征等。肠球菌（B错）可引起腹腔、盆腔感染，败血症、尿路感染等，医院内的尿路感染仅次于大肠埃希菌。变形杆菌（D错）只有离开肠道后才能引起感染，是仅次于大肠埃希菌的泌尿道感染的主要细菌。白色念珠菌（E错）为机会致病菌，主要引起皮肤黏膜感染、内脏感染、中枢系统感染等。